根据中国营养学会推荐，老年人在每日饮食之外，应补充的元素钙剂量为
A. 2000～4000mg
B. 50mg
C. 100mg
D. 500～600mg
E. 1000～1200g

正确答案：D。500～600mg

解析：本题考查钙剂的使用。根据中国营养学会推荐，老年人在每日饮食之外，应补充的元素钙剂量为500～600mg（D对）。《2013版中国居民膳食营养素参考摄入量》建议，成人每日钙摄入推荐量800mg（元素钙），50岁及以上人群每日钙推荐摄入量为1000～1200mg（E错），尽可能通过饮食摄入充足的钙，饮食中钙摄入不足时，可给予钙剂补充。绝经后女性和老年人每日钙摄入推荐量为1000～1200mg。我国老年人平均每日从饮食中获钙约400mg，故每日应补充的元素钙量为500～600mg。